妊娠期凝血因子的变化，哪项是错误的
A. 凝血因子Ⅱ、Ⅴ、Ⅶ、Ⅸ、Ⅹ均增加
B. 凝血因子Ⅺ，ⅩⅢ降低
C. 血小板数增加
D. 凝血时间无明显改变
E. 妊娠期纤溶酶原显著增加

正确答案：C。血小板数增加

解析：妊娠期血液处于高凝状态：①凝血因子Ⅱ、Ⅴ、Ⅶ、Ⅷ、Ⅸ、Ⅹ增加，仅凝血因子Ⅺ、ⅩⅢ降低；②血小板数无明显改变；③血浆纤维蛋白原含量比非孕妇女约增加50%；④妊娠晚期凝血酶原时间及活化部分凝血活酶时间轻度缩短，凝血时间无明显改变；⑤妊娠期纤溶酶原显著增加，优球蛋白溶解时间明显延长，表明妊娠期间纤溶活性降低；⑥于妊娠末期红细胞沉降率加快。掌握“妊娠生理”知识点。